患者女性，24岁，左下智齿低位阻生，注射麻药后出现：头晕、胸闷、面色苍白，脉快而弱，恶心、呼吸困难，血压下降，并有短暂意识丧失。下列采取的措施中，哪项是错误的
A. 输氧
B. 迅速放平椅位
C. 氨水刺激呼吸
D. 针刺人中穴
E. 多巴胺20mg静脉注射

正确答案：E。多巴胺20mg静脉注射

解析：本题考查晕厥的防治措施。多巴胺虽能增加心肌收缩力，增加心排血量使收缩压升高，但对心率增加并不明显（E错，为本题的正确答案）。局麻过程中一旦发生晕厥，应立即停止注射，并给予患者氧气吸入即输氧（A对）。同时迅速放平椅位（B对），以保持患者呼吸通畅。氨水可对呼吸起刺激（C对）作用，常用来治疗晕厥。针刺人中穴（D对）具有醒神开窍、调和阴阳、镇静安神、解痉通脉等功用，可缓解晕厥症状。